当（牙合）力超过牙周组织支持潜能时，最终的病理改变为
A. 组织变性
B. 组织损伤
C. 组织修复
D. 组织改形重建
E. 牙齿脱落

正确答案：D。组织改形重建

解析：本题考查牙槽骨的生物学特性。当（牙合）力超过牙周组织支持潜能时，受压侧牙槽骨吸收，受牵拉侧牙槽骨增生牙齿发生移位，吸收区相对于的外侧骨壁出现代偿性增生，增生区相对应的外侧牙槽骨发生代偿性吸收，同时牙周膜胶原纤维根据牙齿的位置重新排列，最终的病理改变为组织改形重建（D对）。 组织变性（A错）、组织损伤（B错）、组织修复（C错）是支持组织改建的病理变化过程不是最终的病理改变。单纯的咬合力损伤作用长期缓慢，牙周组织有充足的时间改建牙齿一般不会脱落（E错）。